治疗变异型心绞痛的药物是
A. 多巴胺
B. 肾上腺素
C. 维拉帕米
D. 麻黄碱
E. 普萘洛尔

正确答案：C。维拉帕米

解析：变异型心绞痛（P229）特征为静息心绞痛，表现为一过性ST段动态改变，是不稳定型心绞痛（UA）的一种特殊类型，其发病机制为冠状动脉痉挛。钙通道阻滞剂（P232）为血管痉挛性心绞痛的首选药物。维拉帕米属于钙通道阻滞剂的一种，通过扩张痉挛的冠状动脉，恢复心肌供血（C对）。多巴胺常用来治疗心力衰竭，小剂量可降低外周阻力，扩张肾血管，冠脉和脑血管，中剂量可表现为心肌收缩力增强，血管扩张，心率加快不明显，能显著改善心力衰竭的血流动力学异常，大剂量则可出现缩血管作用，增加左心室后负荷（A错）。普萘洛尔为非选择性β肾上腺素受体拮抗药，可阻滞能使冠状动脉扩张的β₂受体，或使α受体相对兴奋，诱发冠状动脉痉挛，使变异型心绞痛加重（E错）。麻黄碱可以收缩血管（D错）。